精神分裂症常见的幻觉是
A. 运动幻觉
B. 视幻觉
C. 听幻觉
D. 触幻觉
E. 嗅幻觉

正确答案：C。听幻觉

解析：幻觉：幻听、幻视（B错）、幻嗅（E错）、幻味、幻触（E错）均可出现，但以幻听最常见。（C对）运动幻觉（A错）少见。